关于腭扁桃体的叙述，不正确的是
A. 是淋巴上皮器官
B. 位于扁桃体窝内
C. 内侧面有许多扁桃体小窝
D. 外侧面及前、后面均有粘膜覆盖
E. 是咽淋巴环的组成部分

正确答案：D。外侧面及前、后面均有粘膜覆盖

解析：腭扁桃体为淋巴上皮器官(A对)，位于扁桃体窝内(B对)，内侧面有许多深的小凹陷为扁桃体小窝(C对)，外侧面及前后面均有结缔组织包绕(D错，为本题正确答案)，参与组成咽淋巴环(E对)。